参与传导躯干和四肢痛温觉和粗略触觉压觉的结构不包括
A. 脊神经节细胞
B. 三叉神经节细胞
C. 脊髓灰质第I、Ⅳ、VII层神经细胞
D. 丘脑腹后外侧
E. 无

正确答案：B。三叉神经节细胞

解析：参与传导躯干和四肢痛温觉和粗略触觉压觉的结构包括第1级神经元：脊神经节细胞（A对），第2级神经元：脊髓灰质第I、Ⅳ、VII层神经细胞（C对），第3级神经元：丘脑腹后外侧核（D对）。三叉神经节细胞（B错，为本题正确答案）不参与这一过程。